全口义齿工作模型的下颌模型在磨牙后垫自其前缘起不少于
A. 6mm
B. 8mm
C. 10mm
D. 12mm
E. 13mm

正确答案：C。10mm

解析：工作模型的要求：模型完整，清晰、准确，充分反映出无牙颌组织面的细微纹路，边缘上显露出肌功能修整的痕迹。模型边缘侧面厚度3mm，模型基底最薄处不能少于10mm。模型后缘应在腭小凹后4mm，下颌模型在磨牙后垫自其前缘起不少于10mm。掌握“无牙颌的印模与模型”知识点。